实验研究和调查研究最根本的区别是
A. 调查研究以人为对象
B. 实验研究以动物为对象
C. 调查研究不能随机分组
D. 实验研究可人为设置处理因素，给予干预措施
E. 调查研究也可以给予干预措施

正确答案：D。实验研究可人为设置处理因素，给予干预措施